麻黄碱的特点包括
A. 激动α、β受体，促进递质释放
B. 明显的中枢抑制作用
C. 不易发生继发性血压下降现象
D. 作用弱而持久
E. 可透过血脑屏障

正确答案：A、C、D、E。激动α、β受体，促进递质释放；不易发生继发性血压下降现象；作用弱而持久；可透过血脑屏障

解析：本题考查麻黄碱的特点。麻黄碱既有激动α和β受体的直接作用（A对），又有促进去甲肾上腺素能神经末梢释放递质的间接作用。（1）心血管系统：心脏兴奋，加强心肌收缩力，增加心排出量。由于血压升高反射性引起迷走神经兴奋，故心率不变或稍缓慢。一般剂量下内脏血流量减少，但冠脉、脑血管和骨骼肌血流量增加。升压作用缓和，持续时间较长，可达3～6小时，无继发性性血压下降（C对）。（2）支气管平滑肌：松弛支气管平滑肌，作用较Adr弱且起效慢，但维持时间长（D对）。（3）中枢神经系统：与Adr不同，麻黄碱具有明显的中枢兴奋作用（B错E对），较大剂量能兴奋大脑皮层和皮层下中枢，可引起不安及失眠等症状。